治疗急性梗阻性化脓性胆管炎最常用的有效手术方式是
A. 胆囊造口术
B. 胆囊切除术
C. 胆总管切开、T管引流术
D. 胆管空肠吻合术
E. 胆囊空肠吻合术

正确答案：C。胆总管切开、T管引流术

解析：急性梗阻性化脓性胆管炎的发病基础是胆道梗阻及细菌感染。如果在疾病发展过程中，胆道梗阻不能解除，胆管内细菌引起的感染得不到控制，将会危及患者生命。应紧急解除胆道梗阻并引流，胆总管切开、T管引流术（C对）简单有效，是治疗急性梗阻性化脓性胆管炎最常用的有效手术方式。胆囊造口术（A错）、胆囊切除术（B错）一般用于治疗急性胆囊炎坏疽穿孔以及胆结石的病人，不用于急性梗阻性化脓性胆管炎的治疗。胆管空肠吻合术（D错）适用于胆囊结石胆囊切除后引流胆汁术。胆囊空肠吻合术（E错）适用于胰头癌的分期手术或胆管下端梗阻。